新生儿寒冷损伤综合症的主要表现是
A. 呼吸暂停
B. 多器官功能损害
C. 心率减慢
D. 低体温和皮肤硬肿
E. 反应低下

正确答案：D。低体温和皮肤硬肿

解析：新生儿寒冷损伤综合征系由寒冷或（和）多种疾病所致，以低体温和皮肤硬肿为主要临床表现（D对），所以又称为新生儿硬肿症。呼吸暂停（A错）和反应低下（E错）是新生儿寒冷损伤综合症的一般表现。多器官功能衰竭（B错）是新生儿寒冷损伤综合症的严重表现。心率减慢（C错）是新生儿寒冷损伤综合症低体温的伴发表现。